无明显肾毒性的药物是
A. 青霉素
B. 环孢素
C. 头孢噻吩
D. 庆大霉素
E. 两性霉素B

正确答案：A。青霉素

解析：本题考查引起肾毒性的药物。无明显肾毒性的药物是青霉素（A错，为本题正确答案）；常见引起肾脏毒性作用的药物有非甾体抗炎药，抗菌药物如氨基糖苷类（D对）、头孢菌素类（C对）、两性霉素B（E对）等，抗肿瘤药甲氨蝶呤、环磷酰胺、氟尿嘧啶等，免疫抑制药环孢素（B对）以及含马兜铃酸的中药等。